涎石病最好发的部位是
A. 腮腺
B. 唇腺
C. 舌下腺
D. 下颌下腺
E. 腭部小涎腺

正确答案：D。下颌下腺

解析：涎石病是在腺体或导管内发生钙化性团块而引起的一系列病变。85%左右发生于下颌下腺，其次是腮腺，偶见于上唇及唇颊部的小唾液腺，舌下腺很少见。掌握“舌下腺及唾液腺黏液囊肿”知识点。